要同时控制早期环境因素和遗传因素对结果的影响，适宜的对照是
A. 邻居对照
B. 配偶对照
C. 同胞对照
D. 人群对照
E. 医院对照

正确答案：C。同胞对照

解析：本题考查对照的选择。同胞对照（C对ABDE错）能够同时控制早期环境因素和遗传因素对研究结果的影响。